女，22岁，突发腹痛12小时。腹痛呈持续性，先以脐部为主，后固定于右下腹，逐渐加重，伴恶心，无呕吐。查体：T37.5℃，P100次／分，R22次／分，BP110/70mmHg。痛苦面容，双肺未闻及啰音，心律齐。腹软，右下腹压痛，无反跳痛，Murphy征阴性，肝脾肋下未触及，肠鸣音减弱。血常规：Hb120g/L，WBC13X10⁹/L，N0.85，Plt200X10⁹/L。拟行手术治疗。该患者术后10天，排便、排尿频繁，伴里急后重感。体温38.5℃.直肠指诊在直肠前壁触及有波动感的包块，触痛明显。最主要的治疗方法是
A. 充分引流
B. 温盐水灌肠
C. 应用抗生素
D. 热水坐浴
E. 物理透热

正确答案：A。充分引流

解析：成年女性患者，突发腹痛12小时。腹痛呈持续性，先以脐部为主，后固定于右下腹，逐渐加重，伴恶心，无呕吐。腹软，右下腹压痛，无反跳痛，Murphy征阴性（排除急性胆囊炎），肝脾肋下未触及，肠鸣音减弱。该患者术后10天，排便、排尿频繁，伴里急后重感（直肠刺激症状）。体温38.5℃，直肠指诊在直肠前壁触及有波动感的包块，触痛明显。综合患者的症状、体征和辅助检查，初步诊断为急性阑尾炎并发盆腔脓肿。最主要的治疗是充分引流（A对）。温盐水灌肠（B错）适用于便秘、某些手术、检查或分娩的准备、稀释和清除肠道内的有害物质以减轻中毒。应用抗生素（C错）适用于单纯性阑尾炎、急性阑尾炎早期阶段。阑尾脓肿非手术疗法如热水坐浴（D错）、物理透热（E错）治愈后其复发率很高。